不属于突发环境污染事件的基本特征
A. 发生时间的突然性
B. 健康危害的短暂性
C. 污染范围的不定性
D. 负面影响的多重性
E. 健康危害的复杂性

正确答案：B。健康危害的短暂性

解析：本题考查突发环境污染事件的基本特征。突发环境污染事件是指在社会生产和人民生活中所使用的化学品、易燃易爆危险品、放射性物品，在生产、运输、贮存、使用和处置等环节中，由于操作不当、交通肇事或人为破坏而造成的爆炸、泄漏，从而造成环境污染和人民群众健康危害的恶性事故。其基本特征有：1.发生时间的突然性（A对）：多在瞬间发生，常常出乎人们的预料；2.污染范围的不定性（C对）：由于造成突发环境污染事件的原因、规模及污染物种类具有很大未知性，故对大气、水域、土壤、森林、绿地、农田等环境介质的污染范围带有很大的不确定性；3.负面影响的多重性（D对）：不论是发达国家，还是发展中国家，突发环境污染事件一旦发生，将对社会安定、经济发展、生态环境、人群健康产生诸多影响，且事件级别越高，危害越严重，恢复重建越困难；4.健康危害的复杂性（E对）：突发环境污染事件可对现场及周围居民产生严重的健康危害，其表现形式与事故的原因、规模、发生形式、污染物种类及理化性质有关。健康危害的短暂性（B错，为本题正确答案）不属于突发环境污染事件的基本特征。